患者可能发生抽搐的是
A. 流产
B. 异位妊娠
C. 早产
D. 妊娠高血压综合征
E. 前置胎盘

正确答案：D。妊娠高血压综合征

解析：妊娠高血压综合征若控制不正确，病情将恶化出现子痫，常发生子痫性抽搐（D对），表现为骤然抽搐，全身肌肉痉挛，抽搐临发作前及发作期间患者神志丧失，多发生于妊娠晚期或临产前，少数发生于分娩中或分娩后。流产（P48）（A错）表现为停经后阴道流血和腹痛。异位妊娠（P51）（B错）多表现为停经后腹痛与阴道流血。早产（P58）（C错）主要临床表现为子宫收缩，伴少许阴道流血或血性分泌物，与临产相似。前置胎盘（P126）（E错）典型症状为妊娠晚期或临产时，发生无诱因、无痛性反复阴道流血。